女性，8岁。右侧颊黏膜破溃2周。口腔检查见：右下Ⅴ残冠，松动Ⅰ°，根尖自附着龈处外露，右颊黏膜可见一直径1cm的溃疡，周边红，右下6已萌出。最佳治疗方法是
A. 干髓术
B. 根管治疗
C. 拔除
D. 拔除，创口愈合后上间隙保持器
E. 口服抗生素，溃疡局部涂2％碘甘油

正确答案：D。拔除，创口愈合后上间隙保持器

解析：右下Ⅴ残冠，松动Ⅰ°，根尖自附着龈处外露，右侧颊黏膜破溃2周可诊断为乳牙根尖周炎已致骨质严重破坏，所以应该拔除，右下6已萌出，Ⅴ早失，磨牙间隙容易变小或消失，应使用间隙保持期保持早失牙齿的近远中和垂直间隙（D对C错）。右下Ⅴ根尖周炎已出现骨质的破，口服抗生素，溃疡局部涂2％碘甘油，只能起到消毒杀菌的作用，不能解决乳牙根尖周炎已导致的根本破坏，且患牙若不拔除会导致病变继续破坏（E错）。根尖及根分叉去骨质破坏广泛是乳牙根管治疗术的禁忌症（B错）。干髓术适用于乳牙牙髓炎，患者为根尖周炎且根尖周骨质破坏，不能用干髓术（A错）。